病例对照研究的优点是
A. 每次只能研究一个因素
B. 需要样本量大
C. 研究所需时间短
D. 可直接计算RR值
E. 不能研究罕见病

正确答案：C。研究所需时间短